不属于环境卫生标准的是
A. 环境空气卫生标准
B. 公共场所卫生标准
C. 污染物排放标准
D. 卫生防护距离标准
E. 环境医学评价技术规范

正确答案：C。污染物排放标准

解析：本题考查环境卫生标准的相关内容。按照污染物在不同环境介质中的性状、转归和侵入人体途径的不同，环境卫生单项标准包括环境空气卫生标准（A对）、公共场所卫生标准（B对）、卫生防护距离标准（D对）、环境医学评价技术规范（E对）等。污染物排放标准（C错，为本题正确答案）属于我国的环境保护标准体系内容。